根据有无暴露某因素史分组的研究是
A. 现况研究
B. 病例对照研究
C. 队列研究
D. 实验流行病学研究
E. 临床试验

正确答案：C。队列研究

解析：队列研究（C对）是一种根据有无暴露某因素史分组的研究方法。病例对照研究（B错）（P059）则是根据是否患有某种待研究的疾病来分组的。临床试验（E错）（P069）是在医院或者其他医疗照顾环境下进行的试验，一般以临床病人为研究对象，以实验组和对照组来区分组别，常用于评价药物或治疗方法的效果。现况研究（A错）（P047）是普查或抽样调查的方法收集一定的数据，并对数据分布特征加以描述的研究方式。实验流行病学研究（D错）（P017）通过人为控制实验相关条件，验证或证实危险因素或可疑病因与疾病之间是否有关联的研究办法。